以下外国药典的缩写是美国药典的是
A. JP
B. USP
C. BP
D. ChP
E. pH.Eur.

正确答案：B。USP

解析：本题考查药典。以下外国药典的缩写是美国药典的是USP（B对）。《美国药典》 （USP）由美国药典委员会编辑出版，现与《美国国家处方集》（NF） 合并出版，缩写为 USP-NF。JP（A错）是《日本药局方》的缩写。BP（C错）是《英国药典》的缩写。ChP（D错）是《中国药典》的缩写。Ph.Eur.（E错）为《欧洲药典》的缩写。